对香加皮的描述正确的是
A. 外表面灰棕色或黄棕色
B. 有香气
C. 两者均是
D. 两者均不是

正确答案：C。两者均是

解析：本题考查的是香加皮药材的性状鉴别。对香加皮的描述正确的是外表面灰棕色或黄棕色与有香气（C对）。香加皮：【性状鉴别】药材呈卷筒状或槽状，少数呈不规则的块片状。外表面灰棕色或黄棕色（A错），栓皮松软常呈鳞片状，易剥落。内表面黄色或淡黄棕色，较平滑，有细纵纹。体轻，质脆，易折断，断面不整齐，黄白色。有特异的香气（B错），味苦。